根尖周脓肿切开排脓术中，橡皮引流条的更换频率是
A. 每天一次
B. 每两天一次
C. 每三天一次
D. 每五天一次
E. 每周一次

正确答案：A。每天一次

解析：急性根尖周脓肿切开排脓时引流条每天更换1次，直至无脓时抽出。掌握“急症处理”知识点。